喉返神经管理
A. 喉内诸肌
B. 环甲肌
C. 喉内诸肌和声门裂以下的粘膜
D. 无以上情况
E. 无

正确答案：D。无以上情况

解析：喉返神经支配声门裂以下喉黏膜及除环甲肌外的所有喉肌，选项中无正确答案（D对）。